具有明目，息风止痉功效的药物是
A. 钩藤
B. 熊胆
C. 水牛角
D. 决明子
E. 夏枯草

正确答案：B。熊胆

解析：熊胆粉（熊胆）性味苦寒，清热解毒之效颇佳，又能消散痈肿，故常用于热毒蕴结所致之疮疡痈疽、痔疮肿痛、咽喉肿痛等，且本品主入肝经，又善于清肝明目退翳，故可用治肝热目赤肿痛，羞明流泪，目生翳膜等症（B对）；水牛角（C错）、钩藤（A错）虽能息风止痉，但没有明目的功效；决明子（D错）、夏枯草（E错）能明目，但没有息风止痉的功效。